脂肪变性最常发生的器官是
A. 肾
B. 脑
C. 肺
D. 脾
E. 肝

正确答案：E。肝

解析：脂肪变性多发生于肝、心、肾等实质器官，由于肝是脂肪代谢的重要场所，因此脂肪变性最常发生于肝（E对）。